在食品腐败变质过程中通常占优势的微生物是
A. 细菌
B. 真菌
C. 酵母菌
D. 寄生虫
E. 病毒

正确答案：A。细菌

解析：本题考查在食品腐败变质过程中通常占优势的微生物。微生物是食品发生腐败变质的重要原因，在食品腐败变质过程中起重要作用的是细菌、酵母菌和真菌，但一般情况下细菌（A对BCDE错）更占优势。